化学品的管理是
A. 地方行为
B. 司法行为
C. 政府行为
D. 安全行为
E. 监督行为

正确答案：C。政府行为